呼吸频率从12次/分增加到24次/分，潮气量从500ml减少到250ml，则
A. 肺通气量增加
B. 肺泡通气量增加
C. 肺泡通气量不变
D. 肺通气量减少
E. 肺泡通气量减少

正确答案：E。肺泡通气量减少